称为“气之根”的脏是
A. 心
B. 肺
C. 脾
D. 肝
E. 肾

正确答案：E。肾

解析：肾主纳气，指肾气的封藏作用在呼吸运动中的具体体现。肾气充沛，摄纳有权，则呼吸均匀和调，气息深深。肺吸入之清气，必须下归于肾，由肾加以摄纳才能保持呼吸通畅，并防止呼吸表浅（E对）。心（A错）的主要生理功能：心主血脉和心藏神。肺（B错）的主要生理功能：主气司呼吸，主行水，朝百脉和主治节。脾（C错）的主要生理功能：主运化和主统血。肝（D错）的主要生理功能：主疏泄和主藏血。